腹膜腔分区的标志为
A. 大网膜
B. 小网膜
C. 肠系膜根
D. 横结肠及其系膜
E. 网膜囊

正确答案：D。横结肠及其系膜

解析：大网膜(A错)可以限制炎症蔓延，小网膜(B错)为分隔左肝下前、后间隙的标志，肠系膜根是肠系膜附着于腹后壁的部分(C错)，腹膜腔分区的标志为横结肠及横结肠系膜(D对)，网膜囊(E错)是小网膜、胃后壁和腹后壁的腹膜之间的扁窄间隙。